成年男性患者，被确诊为HIV感染者，消瘦衰竭经常发生肺感染，造成免疫低下机制主要是
A. 神经胶质细胞减少
B. 树突状细胞减少
C. 吞噬细胞被破坏
D. 中和抗体保护作用低
E. CD4+T细胞大量被破坏

正确答案：E。CD4+T细胞大量被破坏

解析：HIV病毒是一种杀细胞性病毒，此病毒主要在CD4+T淋巴细胞内大量增殖并破坏细胞。而CD4+T淋巴细胞是人体中极其重要的免疫细胞，它的破坏逐渐导致免疫功能衰竭。掌握“人类免疫缺陷病毒”知识点。